头皮裂伤清创的最佳时限，最迟应在
A. 8小时内
B. 12小时内
C. 24小时内
D. 48小时内
E. 72小时内

正确答案：C。24小时内

解析：一般伤口清创的最佳时限为伤后6～8小时内，但在头皮，由于血供丰富，抗感染能力强，其一期缝合时限可放宽至24小时内（C对）。